食管癌大多是
A. 腺癌
B. 鳞状细胞癌
C. 印戒细胞癌
D. 粘液腺癌
E. 小细胞未分化癌

正确答案：B。鳞状细胞癌

解析：食管癌是食管黏膜上皮或腺体发生的恶性肿瘤，绝大多数为鳞状细胞癌（B对），少数可为腺癌（A错），偶见小细胞未分化癌（E错）。分泌大量黏液的腺癌称为粘液腺癌（P97），黏液将细胞核挤向一侧，使细胞呈印戒状，称为印戒细胞癌（P97），这两者多见于胃和大肠（CD错）。